属于手太阳小肠经的穴位是
A. 天府
B. 天宗
C. 天井
D. 天溪
E. 天牖

正确答案：B。天宗

解析：天宗（B对）属于手太阳小肠经。天府（A错）属于手太阴肺经。天井（C错）属于手少阳三焦经。天溪（D错）属于足太阴脾经。天牖（E错）属于手少阳三焦经。